男，15岁。“上呼吸道感染”后2周出现肉眼血尿伴水肿、血压升高。最可能的原因为
A. 左肾静脉受压
B. 尿路结石
C. 泌尿系肿瘤
D. 肾小球肾炎
E. 尿路感染

正确答案：D。肾小球肾炎

解析：青少年男性患者上呼吸道感染多为链球菌感染，2周（急性肾炎的潜伏期内）后出现血尿、水肿、血压升高的肾炎综合征，最可能的诊断为肾小球肾炎（D对）。左肾静脉受压（A错）即胡桃夹综合征，多变现为无痛性血尿和（或）蛋白尿，尿红细胞形态多正常，伴或不伴精索静脉曲张，不会导致水肿及血压升高。尿路结石（B错）多引起肾区疼痛伴肋脊角叩击痛，血尿的多少与结石对尿路粘膜损伤程度有关。泌尿系肿瘤（C错）起病较缓慢，肾癌主要表现为血尿、疼痛和肿块。尿路感染（E错）起病急骤，多有尿频尿急尿痛的膀胱刺激征，上尿路感染多合并有寒战高热等脓毒症状。